银汞合金充填术要制洞，主要因为
A. 充填料粘结力差
B. 充填料有体积收缩
C. 充填料强度不够
D. 便于去龋
E. 充填材料美观性不够

正确答案：A。充填料粘结力差

解析：本题考查银汞合金充填术。银汞合金粘结力差，需要通过窝洞的机械固位保证充填体的稳固，对窝洞制备要求严格，窝洞要有良好的固位形和抗力形（A对）。充填料有体积收缩，可通过增加充填压力来减小（B错）。充填料强度不够，可通过增加合金粉中的银、铜含量等措施来增加充填料的强度（C错）。去腐时及时冲洗窝洞，保持窝洞内清洁，使视野清晰，可利于去腐（D错）。银汞合金美观性差，可选用美观性好的树脂材料充填窝洞（E错）。